脂瘤独有的特征是
A. 数目不等，大小不一，肿形如馒，推之可移
B. 青筋垒垒，盘曲成团，质地柔软，表面青蓝
C. 瘤中心有粗大毛囊孔，可挤出臭味脂浆
D. 瘤体单发，质地硬軔，界限清楚，推之可移
E. 瘤体深隐，质地坚硬，境界清楚，推之不移

正确答案：C。瘤中心有粗大毛囊孔，可挤出臭味脂浆

解析：皮脂腺囊肿称之为“脂瘤”或“粉瘤”，肿物中央皮肤表面可见一小孔，此为腺体导管开口处，有时可见有一黑色粉样小栓，其内容物为灰白色、豆腐渣样物质，有臭味（C对）。脂瘤可单发或多发，多呈圆形，直径多在1～3cm，略隆起（AB错）。质软（DE错），界清，表面与皮肤黏连，稍可移动。